4小时尿量＜100ml者不用
A. 硫酸镁
B. 催产素
C. 麦角新碱
D. 前列腺素
E. 青霉素

正确答案：A。硫酸镁

解析：在硫酸镁应用的注意事项中有这样一条：尿量每小时不少于25ml或每24小时不少于600ml。也可以折算成每4小时尿量不少于100ml，若4小时尿量少于100ml，说明肾功能减退，应减量或停用硫酸镁。否则的话，会引起镁蓄积中毒。掌握“娠期高血压疾病”知识点。